性比例指的是
A. 男性人口与女性人口分别占总人口的比例
B. 男性人口的比例
C. 女性人口的比例
D. 男性人口与女性人口之比
E. 女性人口与男性人口之比

正确答案：D。男性人口与女性人口之比